有权批准医疗机构取得麻醉药品，第一类精神药品的部门是
A. 该区的市级人民政府卫生行政部门
B. 该区的县级人民政府卫生行政部门
C. 该区的省级人民政府卫生行政部门
D. 该区的市级公安部门
E. 医学会

正确答案：A。该区的市级人民政府卫生行政部门

解析：医疗机构需要使用麻醉药品和第一类精神药品的，应当经所在地设区的市级人民政府卫生主管部门（A对）批准，取得麻醉药品、第一类精神药品购用印鉴卡。